根管治疗的疗效评定标准必须包括
A. 症状
B. 临床检查
C. X线表现
D. 以上均包括
E. 以上均不包括

正确答案：D。以上均包括

解析：本题考查疗效评定与牙体修复原则。疗效评定标准必须包括疗效评定标准必须包括症状（A对）、临床检查（B对）和X线表现（C对）。以上均包括，因此选D。